汽车正在行驶中，一名儿童突然冲向马路对面，司机急刹车，汽车在发出刺耳的刹车声后停住，儿童在车前的半米处跑过。这时司机顿时心跳加快，头上冒汗，手足无力，这种情绪状态是
A. 心境
B. 激情
C. 情感
D. 应激
E. 情操

正确答案：D。应激

解析：情绪状态是指在一定的生活事件影响下，一段时间内各种情绪体验的一般特征表现。根据情绪状态的强度和持续时间可分为心境、激情和应激。应激是个体面临或觉察到环境变化对机体有威胁或挑战时做出的适应性和应对性反应的过程。题中的司机看到突然冲入马路的儿童，这一现象是应激源，而后司机紧急刹车是应对行为。一般应激状态使机体具有特殊的防御或排险功能，使人精力旺盛，活动量增大，思维特别清晰，动作机敏，帮助人化险为夷，及时摆脱困境。司机此时心跳加快，头上冒汗，手足无力，属于应激状态（D对）。但应激也会使人产生全身兴奋，注意和知觉的范围缩小、言语不规则、不连贯，行为动作紊乱等表现。紧张而又长期的应激甚至会导致休克和死亡。心境是指微弱而持久，带有渲染性的情绪状态（A错）。激情是一种迅猛爆发、激动短暂的情绪状态，是一种持续时间短、表现剧烈、失去自我控制力的情绪（B错）。情感是指人们对客观事物是否符合自身需要的态度的体验（C错）。情操是指由感情和思想综合起来的，不轻易改变的心理状态（E错）。